关于卵巢形态学特征，说法正确的是
A. 卵巢白膜是平滑肌组织
B. 成年妇女卵巢重约15g
C. 卵巢表面无腹膜
D. 皮质内含血管、神经、淋巴管
E. 髓质内含许多始基卵泡

正确答案：C。卵巢表面无腹膜

解析：成年妇女卵巢重约5～6g（B错）。表面为单层立方上皮即生发上皮，无腹膜覆盖（C对），上皮的深面为卵巢白膜，其是致密纤维组织（A错）。再向内为卵巢实质，分为外层的皮质和内层的髓质。皮质内包含大小不等的各级发育卵泡（包括始基卵泡）（D错）、黄体和它们退化形成的残余结构及间质；髓质内含有疏松结缔组织及丰富的血管、神经、淋巴管（E错）和少量平滑肌纤维。